雷尼替丁治疗十二指肠溃疡的机制是
A. 中和胃酸
B. 直接抑制胃蛋白酶活性
C. 阻断胃腺细胞的H₂受体，抑制胃酸分泌
D. 形成保护膜，覆盖溃疡面
E. 加速胃蛋白酶的分解

正确答案：C。阻断胃腺细胞的H₂受体，抑制胃酸分泌

解析：雷尼替丁属于H₂受体阻断剂，能够选择性阻断胃壁细胞H₂受体，拮抗组胺引起的胃酸分泌（C对），不仅能够抑制基础胃酸的分泌，对促胃液素、食物等引起的胃酸分泌也有抑制作用，临床用于消化性溃疡，十二指肠溃疡、胃肠道出血、胃酸分泌过多等。口服抗酸药后能够中和胃酸（A错），抑制胃蛋白酶活性（B错），降低或消除胃酸、胃蛋白酶对胃、十二指肠黏膜的侵蚀，缓解疼痛，促进溃疡面愈合。黏膜保护药如硫糖铝能够形成保护膜，覆盖溃疡面（D错），防止胃酸、胃蛋白酶损伤胃黏膜，可用于消化性溃疡的治疗。雷尼替丁对胃蛋白酶的降解无明显影响（E错）。